女性患者，心脏联合瓣膜病10年，发热1月，体温为37.2～37.6℃，厌食，消瘦，贫血貌。确诊手段首选
A. 胸部X线
B. 血培养
C. 测定血红蛋白
D. 心肌酶检查
E. 测定血沉

正确答案：B。血培养

解析：女性患者，有长期心脏联合瓣膜病（亚急性IE常见病因）病史，发热1月并伴有厌食、消瘦、贫血貌（亚急性IE常见表现），综合患者的病史和临床表现，该患者最可能的诊断是亚急性感染性心内膜炎（IE）。确诊亚急性感染性心内膜炎首选血培养（B对），在近期未接受过抗生素治疗的患者血培养阳性率可高达95%以上。胸部X线（A错）为影像学检查，不能确诊亚急性IE；测定血红蛋白（C错）可提示贫血程度；心肌酶检查（D错）常用于心肌梗死的诊断；测定血沉（E错）可了解疾病和观察疾病的发展和变化，但对诊断亚急性IE的特异性较差。